24岁，初产妇。停经18周，不觉胎动。产科检查：宫底高度在脐耻之间，胎方位及胎心不清。监测宫内胎儿情况首选的方法是
A. 腹部X线摄片
B. 多普勒超声检查
C. B型超声检查
D. 胎儿心电图检查
E. 测定羊水甲胎蛋白值

正确答案：C。B型超声检查

解析：B超可以观察胎儿大小，胎动及羊水情况，还可以进行胎儿畸形筛查，判定胎位及胎盘位置，对可疑胎儿心脏异常者可应用胎儿超声心动诊断仪对胎儿心脏的结构与功能进行检查，因此B型超声检查（C对）是监测宫内胎儿情况首选的检查方法。腹部X线摄片（A错）有辐射，对胎儿有害，不宜使用。多普勒超声检查（B错）能监测胎儿脐动脉和大脑中动脉血流，对胎儿进行血流动力学监测，不作为监测宫内胎儿情况首选的检查方法。胎儿心电图检查（D错）能监测胎心率和判断胎儿心动有无异常，不作为监测宫内胎儿情况首选的检查方法。测定羊水甲胎蛋白值（E错）能判断胎儿有无畸形与宫内发育情况，但缺乏安全性、简便性与高效性，因此不作为监测宫内胎儿情况首选的检查方法。